呕血呈暗红色，是由于
A. 在胃中停留时间长，被氧化
B. 是静脉血，非动脉血
C. 血红蛋白与胃酸结合而变性
D. 病人在缺氧情况下发生呕血
E. 血红蛋白与硫化物结合而变性

正确答案：C。血红蛋白与胃酸结合而变性

解析：呕血时，出血量较少或在胃内停留时间长，由于血红蛋白与胃酸结合而变性（C对A错）形成酸化正铁血红蛋白，故呈暗红色。较高位的消化道出血时，血中血红蛋白与肠内硫化物结合而变性（E错）形成硫化铁，使大便呈黑色柏油样便。静脉血，非动脉血（B错）、病人在缺氧情况下发生呕血（D错）均不会导致呕血呈暗红色。